不能经虫媒传播感染的病毒是
A. 乙型脑炎病毒
B. 森林脑炎病毒
C. 登革热病毒
D. 狂犬病病毒
E. 黄热病病毒

正确答案：D。狂犬病病毒

解析：狂犬病是一种侵害中枢神经系统的急性病毒性传染病，所有温血动物包括人类，都可能被感染。多由染病的动物咬人而得。乙型脑炎病毒：带毒雌蚊。森林脑炎病毒：蜱。登革热病毒：埃及伊蚊和白伊蚊。黄热病病毒：在城市是埃及伊蚊，在农村为趋血蚊和非洲伊蚊。掌握“病毒传播方式、感染类型、致病机制及免疫”知识点。